男，58岁，突发性头颈项剧烈疼痛，伴有大汗、恶心、呕吐1小时。查体：急性病容，四肢活动自如，脑膜刺激征阳性，此时的诊断为
A. 脑栓塞
B. 脑血栓形成
C. 高血压脑病
D. 蛛网膜下腔出血
E. 脑干出血

正确答案：D。蛛网膜下腔出血

解析：中年男性患者，突发性头颈项剧烈疼痛，伴有大汗、恶心、呕吐1小时（蛛网膜下腔出血表现）。查体：急性病容，四肢活动自如，脑膜刺激征阳性（蛛网膜下腔出血典型征象），故患者诊断为蛛网膜下腔出血（D对）。脑栓塞、脑血栓形成一般表现都有偏瘫或运动困难（AB错）。高血压脑病一般患者有高血压病史（C错）。脑干出血一般表现为呕吐、言语不清、昏迷等症状（E错）。